房水和房水循环的描述，错误的是
A. 为无色透明的液体，有折光作用
B. 房水可维持正常的眼内压
C. 房水由睫状体产生，充填于眼前房内
D. 眼前房和眼后房的压力大致相等
E. 房水循环受阻可造成眼内压增高

正确答案：C。房水由睫状体产生，充填于眼前房内

解析：房水为无色透明的液体，有折光作用（A对），由睫状体产生，充填于整个眼房内，而非仅仅是眼前房（C错，为本题正确答案），可维持正常的眼内压（B对）。眼前房和眼后房借瞳孔交通，故眼前房和眼后房的压力大致相等（D对）。房水循环受阻可造成眼内压增高（E对）。